坏疽是指坏死组织表现为
A. 干酪样改变
B. 淤血性改变
C. 腐败菌的感染
D. 充血性改变
E. 缺血性改变

正确答案：C。腐败菌的感染

解析：坏疽是指坏死组织表现为腐败菌感染（C对）。干酪样改变（A错）是坏死更为彻底的凝固性坏死，常见于结核肉芽肿（P351）。淤血性改变（B错）、充血性改变（D错）及缺血性改变（E错）均为局部血液循环障碍所致的病理改变，但不是组织细胞损伤的表现形式。